注射用油、液体石蜡的灭菌宜采用
A. 干热灭菌法
B. 热压灭菌法
C. 流通蒸汽灭菌法
D. 环氧乙烷灭菌法
E. 紫外线灭菌法

正确答案：A。干热灭菌法

解析：本题考查灭菌方法。注射用油、液体石蜡的灭菌宜采用干热灭菌法（A对）。干热灭菌法：干热灭菌法是指在干热环境中灭菌的方法，包括火焰灭菌法和干热空气灭菌法。此法适用于耐高温但不宜用湿热灭菌法灭菌的物品灭菌，如玻璃器具、金属制容器、纤维制品、固体试药、液状石蜡等均可采用本法灭菌。缺点是穿透力弱，温度不易均匀，而且灭菌温度较高，灭菌时间较长，不适于橡胶、塑料及大部分药品的灭菌。热压灭菌法（B错）：是采用高压饱和水蒸气加热杀灭微生物的方法。此法具有很强的灭菌效果，灭菌可靠，能杀灭所有细菌繁殖体和芽胞，是在制剂生产中应用最广泛的一种灭菌方法。凡能耐高压蒸汽的药物制剂、玻璃容器、金属容器、瓷器、橡胶塞、膜过滤器等均能采用此法。流通蒸汽灭菌（C错）：是在常压下使用100℃流通蒸汽加热杀灭微生物的方法。通常灭菌时间为30～60min。此法适用于消毒及不耐高热的制剂的灭菌，但不能保证杀灭所有的芽胞，系非可靠的灭菌法，一般可作为不耐热无菌产品的辅助灭菌手段。环氧乙烷（D错）：为广谱杀菌剂，具有很强的扩散和穿透能力，可以穿透塑料、橡胶、纸板等，常用于塑料容器、橡胶制品、纸或塑料包装的固体药物、衣物、敷料、医疗器械，如一次性注射器、一次性输液器等卫生材料的灭菌。一般与80%～90%的惰性气体混合使用，在充有灭菌气体的高压腔室内进行。环氧乙烷灭菌法的最大缺点是：具有易燃、易爆性；对人体皮肤、眼黏膜有损害，并且可产生吸入毒性。紫外线灭菌法（E错）：紫外线灭菌法是指用紫外线照射杀灭微生物的方法。本法适用于物品表面的灭菌、无菌室空气及蒸馏水的灭菌；不适用于药液和固体物质深部的灭菌；普通玻璃容器可吸收紫外线，因此装于其中的药物不能用此法灭菌。